其诊断应是
A. 痈
B. 疔
C. 疖
D. 有头疽
E. 无头疽

正确答案：C。疖

解析：题中红、肿、热、痛，肿胀部突起根浅，肿势局限，范围在3cm左右，易脓，易溃，易敛等表现符合疖的临床特点（C对）。痈常为单发，初起无头，局部顶高色赤，表皮紧张光亮，肿势范围较大，约6cm~9cm，初起即伴有明显全身症状（A错）。疔多发于颜面和手足等处。其特点是疮形虽小，但根脚坚硬，有如钉丁之状，病情变化迅速。容易造成毒邪走散（B错）。有头疽的特点是初起皮肤上即有粟粒样脓头，焮热红肿胀痛，迅速向深部及周围扩散，脓头相继增多，溃烂后状如莲蓬、蜂窝（D错）。无头疽的特点是多见于儿童，发病急骤，初起无头，发无定处，病位较深，漫肿，皮色不变，疼痛彻骨，难消，难溃，难敛（E错）。